血液凝固的本质是
A. 纤维蛋白的溶解
B. 纤维蛋白的激活
C. 纤维蛋白原变为纤维蛋白
D. 血小板的聚集
E. 凝血因子Ⅻ的激活

正确答案：C。纤维蛋白原变为纤维蛋白